女性，20岁，反复发作喘息、呼吸困难、咳嗽2年。体检：双肺散在哮鸣音，心脏无异常。下列检查结果中有助于明确诊断的是
A. 最大呼气流量显著降低
B. 一秒钟用力呼气容积降低
C. 最大呼气中段流量降低
D. 支气管舒张试验阳性
E. X线胸片显示肺纹理稍多

正确答案：D。支气管舒张试验阳性

解析：患者为青年女性，反复发作喘息、呼吸困难、咳嗽，有双肺散在的哮鸣音，考虑为支气管哮喘。支气管舒张试验阳性（D对）（吸入支气管舒张剂后，FEV₁较用药前增加≥12%，且其绝对值增加≥200ml，判断结果为阳性）即提示存在可逆性的气道阻塞，为支气管哮喘诊断标准之一，可明确诊断。支气管哮喘患者最大呼气流量（A错）、一秒钟用力呼气容积（B错）及最大呼气中段流量（C错）均降低，但不能作为明确诊断的依据，因为在慢性阻塞性肺疾病中也可以出现类似的改变。X线胸片肺纹理稍多（E错）见于慢性支气管炎等疾病，支气管哮喘发作时可见两肺透亮度增加，呈过度通气状态，缓解期多无明显异常。